大黄与芒硝相配伍，属于哪种配伍关系
A. 相使
B. 相须
C. 相畏
D. 相杀
E. 相恶

正确答案：B。相须

解析：相须，即性能功效相类似的药物配合应用，可以增强其原有疗效。大黄与芒硝均为泻下药，常相须为用，以增强泻下通便作用（B对）。相使（A错），即将性能功效方面有某些共性，或性能功效虽不相同，但是治疗目的一致的药物配合应用，其中以一种药物为主，另一种药物为辅，两药合用，辅药能提高主药的功效。相畏（C错）就是一种药物的毒性或副作用能被另一种药物降低或消除。相杀（D错）指一种药物能够降低或消除另一种药物的毒性或副作用。相恶（E错）即两种药物合用，一种药物能使另一药物原有功效降低，甚至丧失。